属于描述性研究的是
A. 疾病监测
B. 队列研究
C. 临床试验
D. 临床指南
E. 系统评价

正确答案：A。疾病监测

解析：本题考查描述性研究的类型。描述性研究常见的类型主要有：现状研究、疾病监测（A对）、生态学研究、病例报告、病例系列分析、个案研究、历史资料分析、随访研究等。队列研究（B错）属于分析性研究。临床试验（C错）属于实验性研究。临床指南（D错）和系统评价（E错）属于研究结果的综合。